男性，45岁，上颌8621│136缺失，5│57颊倾，颊侧观测线位于（牙合）1/3，可摘局部义齿修复时正确的做法是
A. 将模型向右侧倾斜，义齿斜向就位
B. 将模型向后倾斜，义齿向后上就位
C. 5│57设计杆型卡环
D. 磨改5│57颊面形态，降低观测线位置
E. 4│48做基牙

正确答案：D。磨改5│57颊面形态，降低观测线位置

解析：该病例设计可摘局部义齿时57│57做基牙是最佳选择，而选择4│48做基牙效果不佳。由于基牙颊侧观测线位置过高，倒凹过大，影响卡环的放置。采用圆环形卡环时颊侧卡环臂位置过高，对基牙侧向力大；采用杆型卡环时卡环将无法就位，或者造成卡环臂及其延伸臂与基牙和黏膜间隙过大。由此设计杆型卡环不能解决问题。将模型向左或右倾斜只能减小对侧基牙颊侧倒凹，同侧倒凹反而加大。模型前后倾斜只会改变倒凹的近远中位置，但不能改变倒凹的深度。由此，正确的方法只能是磨改基牙颊面形态，磨除过突的部分，降低观测线高度。掌握“局部义齿的设计”知识点。